按《中国药典》药材取样法规定，对待检的一般药材1500件，应抽检的包件数是
A. 65件
B. 60件
C. 55件
D. 50件
E. 45件

正确答案：C。55件

解析：本题考查的是取样原则。按《中国药典》药材取样法规定，对待检的一般药材1500件，应抽检的包件数是55件（C对）。取样原则①取样前应作详细记录，注意品名、产地、规格、等级及各包件是否一致，检查包装的完整性、清洁程度及霉变或其他物质污染等。②同批药材总包件数不足5件的，逐件取样；5～99件，随机抽5件取样；100～1000件，按5%比例取样；超过1000件的，超过部分按1%比例取样；包件少的抽取总量应不少于实验用量的3倍；贵重药材，不论包件多少均逐件取样。③每一包件的取样量：一般药材抽取100～500g；粉末状药材抽取25～50g；贵重药材抽取5～10g。④最终抽取的供检验用样品量，一般不得少于检验所需用量的3倍，即1/3供实验室分析用，另1/3供复核用，其余1/3留样保存。